化学性发绀是哪种毒物中毒时的典型症状
A. 苯胺
B. 氰化氢
C. 苯
D. 三硝基甲苯
E. 一氧化碳

正确答案：A。苯胺

解析：本题考查苯胺中毒的症状。当短时间内吸收大量苯胺，可引起苯胺（A对BCDE错）的急性中毒。早期表现为发绀，最先见于口唇、指端及耳垂等部位，其色调与一般缺氧所见的发绀不同，呈蓝灰色，称为化学性发绀。